自然灾害发生后，应对饮用水水质进行检验。水质检验一般分析通常不包括
A. 毒理指标
B. 化学指标
C. 放射性指标
D. 感官和污染指标
E. 消毒剂及微生物指标

正确答案：C。放射性指标

解析：本题考查水质检验一般分析的项目。自然灾害发生后，应对饮用水水质进行检验。水质检验一般分析项目通常包括：感官、污染（D对）、毒物（A对）、化学（B对）、消毒剂、微生物指标（E对）。放射性指标（C错，为本题正确答案）属于水质检验项目。